保守医疗秘密之两方面的内容是指
A. 为患者保密与对患者保密
B. 为患者保密与对患者家属保密
C. 为患者家属保密与对患者保密
D. 为患者家属保密与对患者家属保密
E. 为医院保密与对同事保密

正确答案：A。为患者保密与对患者保密